微量元素是指
A. 人体含量很少的元素
B. 食物中含量很少的元素
C. 自然界含量很少的元素
D. 人体吸收率很低的元素
E. 人体利用率很低的元素

正确答案：A。人体含量很少的元素

解析：按照化学元素在机体内含量的多少，通常将矿物质元素分为常量元素和微量元素两类。凡体内含量大于体重0.01%的称为常量元素或宏量元素，它包括钙、磷、钠、钾、硫、氯、镁。凡体内含量小于体重0.01%的称为微量元素。